每公斤体重的总摄氟量在多少为宜
A. 0.01～0.02mg
B. 0.02～0.03mg
C. 0.05～0.06mg
D. 0.03～0.05mg
E. 0.05～0.07mg

正确答案：E。0.05～0.07mg

解析：本题考查每公斤体重的适宜氟摄入量。每公斤体重的总摄氟量在0.05～0.07mg（E对）为宜。氟的适宜摄入量和安全摄入量的标准难以统一，因此只提供一个范围，即每公斤体重每天的摄氟量在0.05～0.07mg为适宜的，一般不应超过上限